小儿初次感染结核菌素至产生变态反应的时间是
A. 48～72小时
B. 4～6天
C. 1～2周
D. 2.5～3周
E. 4～8周

正确答案：E。4～8周

解析：小儿感染结核杆菌素后，需4～8周（E对）才建立充分变态反应。